最易触及心包摩擦感的是
A. 坐位，胸骨左缘第4肋间处，深呼气末
B. 坐位，胸骨左缘第4肋间处，深吸气末
C. 卧位，胸骨左缘第2肋间处，深呼气末
D. 卧位，胸骨左缘第2肋间处，深吸气末
E. 卧位，剑突下，屏住呼吸时

正确答案：A。坐位，胸骨左缘第4肋间处，深呼气末

解析：心包摩擦音可在整个心前区听到，但以胸骨左缘第3、4肋间最响亮，坐位前倾及呼气末更明显（A对）。